疱在基底层之下，基底细胞变性，使上皮全层与固有层分离，见于
A. 多形性红斑
B. 扁平苔藓
C. 慢性盘状红斑狼疮
D. 念珠菌病
E. 疱疹性口炎

正确答案：A。多形性红斑

解析：疱在基底层之下，基底细胞变性，使上皮全层与固有层分离。见于黏膜良性类天疱疮、多形渗出性红斑。基底细胞空泡性变及液化常见扁平苔藓和红斑狼疮。掌握“口腔念珠菌病与肉芽肿性唇炎”知识点。